男，26岁。脑外伤患者，头痛、头晕14天加重伴频繁呕吐1天。查体：BP140/78mmHg，嗜睡。双侧瞳孔大小多变，头颅MRI显示第四脑室肿瘤，伴幕上脑室扩大。引起病情急剧恶化最可能的原因是
A. 脑水肿
B. 脑积水
C. 小脑幕切迹疝
D. 大脑镶下疝
E. 枕骨大孔疝

正确答案：E。枕骨大孔疝

解析：青年男性，外伤后，头痛、头晕14天加重伴频繁呕吐1天，查体：BP140/78mmHg（正常值为90～140/60～90mm/Hg），嗜睡，双侧瞳孔大小多变（枕骨大孔疝的特征性体征），头颅MRI显示第四脑室肿瘤（脑疝的常见病因），伴幕上脑室扩大，根据患者的临床症状、体征及影像学检查，考虑引起病情急剧恶化最可能的原因是枕骨大孔疝（E对），小脑幕切迹疝（C错）的瞳孔改变是病初病侧瞳孔缩小，随着病情进展瞳孔逐渐增大。大脑镰下疝（D错）患者的瞳孔一般无异常改变，症状主要是对侧下肢瘫痪、排尿障碍或感觉减退等。脑水肿（A错）一般瞳孔不改变，严重时瞳孔不等大。脑积水（B错）的瞳孔改变多为散大。